能够激活补体经典途径
A. C-反应蛋白
B. 纤维连接蛋白
C. 白蛋白
D. 血浆铜蓝蛋白
E. α-抗糜蛋白酶

正确答案：A。C-反应蛋白

解析：C-反应蛋白（A对）能够激活补体经典途径。